治疗癫痫持续状态的首选药是
A. 乙琥胺
B. 苯妥英钠
C. 硝西泮
D. 地西泮
E. 丙戊酸钠

正确答案：D。地西泮

解析：癫痛持续状态：首要措施是尽快控制惊厥发作，首选静脉注射地西泮（D对）。